氧化锌制剂处方如下：【处方】氧化锌250g；淀粉250g；羊毛脂250g；凡士林250g。该制剂是
A. 软膏剂
B. 糊剂
C. 硬膏剂
D. 乳膏剂
E. 凝胶剂

正确答案：B。糊剂

解析：本题考查糊剂。该制剂是糊剂（B对）。糊剂系指大量的原料药物固体粉末（一般25%以上）均匀地分散在适宜的基质中所组成的半固体外用制剂。冬季时可用5%液状软膏剂（A错）指药物与适宜基质均匀混合制成的具有一定稠度的半固体外用制剂；硬膏剂（C错）是具有黏性而供外贴的制剂；乳膏剂（D错）系指原料药物溶解或分散于乳状液型基质中形成的均匀的半固体制剂；凝胶剂（E错）系指原料药物与能形成凝胶的辅料制成的具凝胶特性的稠厚液体或半固体制剂。